他汀类调节血脂药物的主要作用机制是
A. 阻止胆固醇从肠道吸收
B. 降低甘油三酯脂酶活性
C. 抑制HMG-CoA还原酶
D. 抑制游离脂肪酸释放
E. 激活脂蛋白脂酶活性

正确答案：C。抑制HMG-CoA还原酶

解析：本题考查他汀类调血脂药。他汀类调节血脂药物的主要作用机制是抑制HMG-CoA还原酶（C对）。他汀类药物因其本身或其代谢物的结构与HMG-CoA相似，可在胆固醇合成的早期阶段竞争性地抑制HMG-CoA还原酶活性，使甲羟戊酸形成障碍，阻碍肝脏内源性胆固醇的合成，而代偿性地增加了肝细胞膜上的LDL受体的合成。使血浆中大量的LDL被摄取，经LDL受体途径代谢为胆汁酸排出体外，降低LDL水平。阻止胆固醇从肠道吸收（A错）是胆固醇吸收抑制剂的主要作用机制。降低甘油三酯脂酶活性（B错）和激活脂蛋白脂酶活性（E错）的是贝特类调血脂药。抑制游离脂肪酸释放（D错）的是烟酸类药物的主要作用机制。